《中国药典》规定，以东莨若碱为指标成分进行含量测定的药材是
A. 洋金花
B. 马钱子
C. 葛根
D. 防己
E. 延胡索

正确答案：A。洋金花

解析：本题考查的是洋金花的化学成分。《中国药典》规定，以东莨若碱为指标成分进行含量测定的药材是洋金花（A对）。《中国药典》以东莨菪碱为指标成分对洋金花进行含量测定，要求东莨菪碱不得少于0.15%。《中国药典》以士的宁和马钱子碱为指标成分对马钱子（B错）进行含量测定，要求士的宁的含量应为1.20%～2.20%，马钱子碱的含量不得少于0.80%。《中国药典》以葛根素为指标成分对葛根（C错）进行含量测定，要求含葛根素不得小于2.4%。《中国药典》以粉防己碱和防己诺林碱为指标成分对防己（D错）进行含量测定，对药材要求两者总量不得少于1.6%；对饮片要求两者总量不得少于1.4%。《中国药典》以延胡索乙素为指标成分对延胡索（E错）进行含量测定，要求含量不得少于0.050%。